下列不属于氟尿嘧啶治疗的疾病是
A. 食管癌
B. 胃癌
C. 肺癌
D. 胰腺癌
E. 肝癌

正确答案：C。肺癌

解析：氟尿嘧啶的临床应用：对消化系统癌（食管癌、胃癌、肠癌、胰腺癌、肝癌）和乳腺癌疗效较好，对宫颈癌、卵巢癌、绒毛膜上皮癌、膀胱癌、头颈部肿瘤也有效。环磷酰胺的临床应用：抗瘤谱广，为目前广泛应用的烷化剂。对恶性淋巴瘤疗效显著，对多发性骨髓瘤、急性淋巴细胞白血病、肺癌、乳腺癌、卵巢癌、神经母细胞瘤和睾丸肿瘤等均有一定疗效。掌握“抗恶性肿瘤药”知识点。